38岁女性患者肖某，唇部及口腔内不明原因溃烂2周，疼痛剧烈，说话及进食困难。患者去年发生过类似疾病。检查：唇部糜烂，易出血，结血痂。舌背、口底及右颊部有大面积糜烂，上覆黄色假膜。两手掌有圆或椭圆形红斑。该患者可能的诊断是
A. 天疱疮
B. 药物性口炎
C. 盘状红斑狼疮
D. 多形渗出性红斑
E. 糜烂型扁平苔藓

正确答案：D。多形渗出性红斑

解析：本题考查多性红斑的临床表现。38岁女性患者肖某，唇部及口腔内不明原因溃烂2周，疼痛剧烈，说话及进食困难。患者去年发生过类似疾病。检查：唇部糜烂，易出血，结血痂。舌背、口底及右颊部有大面积糜烂，上覆黄色假膜。两手掌有圆或椭圆形红斑。该患者可能的诊断是多形渗出性红斑（D对）。患者的典型症状有唇部糜烂，出血结痂，糜烂面有黄色假膜，两手掌有椭圆形红斑，患者的临床表现符合多形渗出性红斑的病变特点。天疱疮（A错）的疱疹为逐渐发生，疱愈合后便可在愈合处再次起疱，有长期性，而多形渗出性红斑为急性发病，且病程有自限性，相对短暂。药物性口炎（B错）发病前有用药史，用药和发病时间有因果关系。盘状红斑狼疮（C错）的黏膜病损特点为圆形或椭圆形红斑糜烂凹下似盘状，周围有红晕，红晕外围有呈放射状排列的细短白纹，皮肤损害的典型病损长发生在鼻梁和鼻侧以及双侧颧部皮肤所构成的、状似蝴蝶形的区域，称为蝴蝶斑。糜烂型扁平苔藓（E错）有典型的口腔黏膜白色损害，皮肤病损无靶形红斑。